地图舌的病损边缘表现为
A. 丝状乳头剥脱
B. 微凹陷
C. 红色光滑区
D. 红斑
E. 高起

正确答案：E。高起

解析：地图舌表现为舌背丝状乳头呈片状剥脱，微凹陷，形成光滑的红色剥脱区，故也称剥脱性舌炎。但是菌状乳头常清晰可见，其边缘为白色微高起的弧形、圆形或椭圆形包绕。掌握“地图舌、沟纹舌及舌乳头炎”知识点。